免疫监视功能低下时，易发生
A. 超敏反应
B. 肿瘤
C. 自身免疫病
D. 移植排斥反应
E. 免疫缺陷病

正确答案：B。肿瘤

解析：免疫监视即免疫系统具有的识别、杀伤并及时清除体内突变细胞，防止肿瘤发生的功能。本题易错选免疫缺陷病，免疫缺陷是由于各种不同因素导致的免疫功能损伤的疾病。如先天因素：胚胎发育过程中，母体受到病毒、寄生虫感染，或发生基因突变，可能使胎儿免疫功能异常或提高发病风险。遗传因素。获得性因素。等等